经腕管进入手掌的神经为
A. 尺神经
B. 正中神经
C. 桡神经
D. 肌皮神经
E. 骨间掌侧神经

正确答案：B。正中神经

解析：尺神经（A错）在桡腕关节上方尺神经发出手背支后，主干在豌豆骨桡侧，屈肌支持带浅面分为浅支和深支，在掌腿膜深面、腕管浅面进入手掌。正中神经（B对）进入屈肌支持带深面的腕管，最后在掌腱膜深面分布至手掌。桡神经（C错）在肱骨外上髁上方穿过外侧肌间隔至肱桡肌与肱肌之间，继续下行于肱肌与桡侧腕长伸肌之间。肌皮神经（D错）从肱二头肌下端外侧穿出深筋膜，分布于前臂外侧份的皮肤。